天花粉的功效是
A. 清热泻火，除烦止渴
B. 清热泻火，清肺润燥
C. 清热生津，止呕除烦
D. 清热生津，消肿排脓
E. 泻火除烦，凉血利湿

正确答案：D。清热生津，消肿排脓

解析：天花粉苦寒清泄，微甘而润，且兼行散，入肺、胃经，为清润消肿排脓之品。既善清肺胃之热而生津液、润肺燥，又能消肿痛、排疮脓而疗疮治伤。天花粉的功效是清热泻火，生津止渴，消肿排脓（D对）。清热泻火，除烦止渴（A错）是石膏的功效。清热泻火，清肺润燥（B错）是知母的功效。清热生津，止呕除烦（C错）是芦根的功效。泻火除烦，凉血利湿（E错）是栀子的功效。